亚甲蓝（美蓝）作为以下哪种毒物中毒的解毒剂
A. 苯胺
B. 三硝基甲苯
C. 苯
D. 二甲苯
E. 甲苯

正确答案：A。苯胺